下列辅料中，属于肠溶性载体材料的是
A. 聚乙二醇类
B. 聚维酮类
C. 醋酸纤维素酞酸酯
D. 胆固醇
E. 磷脂

正确答案：C。醋酸纤维素酞酸酯

解析：本题考查肠溶性载体材料。固体分散物的肠溶性载体材料包括纤维素类和聚丙烯酸树脂类。纤维素类常见的肠溶性纤维素，如醋酸纤维素酞酸酯（CAP）（C对）、羟丙甲纤维素酞酸酯（HPMCP）、羧甲乙纤维素（CMEC）等。聚丙烯酸树脂类常见的有国产的Ⅱ号和Ⅲ号丙烯酸树脂（相当于国外商品名Eudragit L和Eudragit S型）等肠溶性材料。聚乙二醇类（A错）和聚维酮类（B错）为高分子聚合物类水溶性载体材料。胆固醇（D错）和磷脂（E错）用于脂质体的制备，并无肠溶的特性。